属眼球壁中膜的结构是
A. 角膜
B. 视网膜
C. 虹膜
D. 巩膜

正确答案：C。虹膜

解析：角膜（A错）和巩膜（D错）属于眼球纤维膜，即眼球外膜。虹膜（C对）属于眼球中膜。视网膜（B错）是眼球内膜。